具有利尿，止汗，安胎功效的药物是
A. 黄芩
B. 甘草
C. 白术
D. 大枣
E. 党参

正确答案：C。白术

解析：白术具有利尿，止汗，安胎的功效（C对）。黄芩的功效是清热燥湿，泻火解毒，止血，安胎不具有止汗，安胎的功效（A错）。甘草的功效是补脾益气，清热解毒，祛痰止咳，缓急止痛，调和诸药不具有利尿，止汗，安胎的功效（B错）。大枣的功效是补中益气，养血安胎不具有利尿，止汗的功效（D错）。党参的功效是补脾肺气，补血,生津不具有利尿，止汗，安胎的功效（E错）。综上可知治疗利尿，止汗，安胎功效的药物是白术。